手性药物的对映异构体之间可能
A. 具有等同的药理活性和强度
B. 产生相同的药理活性，但强弱不同
C. 一个有活性，一个没有活性
D. 产生相反的活性
E. 产生不同类型的药理活性

正确答案：A、B、C、D、E。具有等同的药理活性和强度；产生相同的药理活性，但强弱不同；一个有活性，一个没有活性；产生相反的活性；产生不同类型的药理活性

解析：本题考查药物的手性特征及其对药物作用的影响。有些对映异构体之间具有等同的药理活性和强度（A对）如普罗帕酮；有些对映异构体之间产生相同的药理活性，但强弱不同（B对），如氯苯那敏；有些对映异构体中一个有活性，一个没有活性（C对）如L-甲基多巴；有些对映异构体之间产生相反的活性（D对）如扎考必利；有些对映异构体之间产生不同类型的药理活性（E对）如丙氧酚。